保护易感人群最重要的措施是
A. 人工自动免疫
B. 人工被动免疫
C. 药物预防
D. 个体防护
E. 自然自动免疫

正确答案：A。人工自动免疫

解析：本题考查保护易感人群的措施。人工自动免疫（A对BCDE错）指采用人工免疫的方法将疫（菌）苗和类毒素等抗原接种到人体，使机体自身的免疫系统产生对相关传染病的特异性免疫力，是保护易感人群最重要的措施。